初产妇，规律宫缩5小时，宫口开3cm，行人工破膜后9小时宫口开9cm，先露坐骨棘下2cm，诊断为
A. 活跃期延长
B. 活跃期停滞
C. 胎头下降延缓
D. 正常产程
E. 第二产程延长

正确答案：D。正常产程